HE染色切片中，发现肝细胞体积变大，胞浆淡染呈空泡状。为确定空泡的性质，最常用
A. 苏丹Ⅲ染色
B. 普鲁士蓝染色
C. 嗜银染色
D. 免疫组化
E. 电镜检查

正确答案：A。苏丹Ⅲ染色

解析：肝细胞是脂肪代谢的重要场所，当HE染色切片中发现肝细胞体积变大，胞浆淡染呈空泡状时，最有可能是肝细胞发生了脂肪样变，脂肪可被切片中的有机溶剂溶解成空泡状的脂滴。故为了区分出脂滴，通常可用苏丹Ⅲ（A对）等特殊染色。普鲁士蓝染色（B错）常用来检测氰化物。嗜银染色（P322）（C错）常用来检测嗜银细胞（透明细胞）。免疫组化（D错）在临床上主要用于肿瘤的诊断和鉴别诊断。电镜检查（E错）是病理学中最普遍应用的检测方法，无特异性。